膈的功能的是
A. 收缩时，膈穹窿下降，助呼气
B. 收缩时，膈穹窿上升，助吸气
C. 收缩时，膈穹窿下降，助吸气
D. 舒张时，膈穹窿下降，助呼气
E. 舒张时，膈穹窿上升，助吸气

正确答案：C。收缩时，膈穹窿下降，助吸气

解析：膈的功能的是收缩时，膈穹窿下降，助吸气（C对）。